患者病情加重，出现喘渴烦躁，手足虽温而汗多欲脱，脉数疾等，属于
A. 气虚
B. 阳虚
C. 亡阴
D. 亡阳
E. 闭厥

正确答案：C。亡阴

解析：患者病情加重，出现烦躁，是因为阴竭阳气浮亢，上扰心神；口渴，是由于阴亏而致阴液损失过多；患者病情加重，出现烦躁，是因为阴竭阳气浮亢，上扰心神；口渴，是由于阴亏而致阴液损失过多；手足虽温而汗多欲脱，是由于阴液亏虚欲绝，阴竭阳浮，迫津外泄；脉数疾，为阴伤重证之候（C对）。气虚证主要表现为神疲乏力，少气懒言，脉虚（A错）。阳虚证主要表现为畏寒肢冷（B错）。亡阳证主要表现为冷汗、肢厥、面白、脉微（C错）。闭厥即痰闭惊厥，主要表现为牙关紧闭，双目上窜，四肢抽搐（E错）。